下列临床表现最有利于有机磷农药中毒诊断的是
A. 紫绀
B. 昏迷
C. 气急
D. 蒜臭
E. 腹泻

正确答案：D。蒜臭

解析：有机磷农药中毒的特殊体征为呼出气有大蒜气味（D对），紫绀（A错）、昏迷（B错）、气急（C错）、腹泻（E错）不仅可见于有机磷农药中毒患者，亦可见于其他化学物质中毒，不存在特异性。